《国家药品安全“十二五”规划》确定的国家药品安全“十二五”规划指标有
A. 到“十二五”末，中药标准主导国际标准制定
B. 到“十二五”末，零售药店全部实现营业时有执业药师指导合理用药
C. 到“十二五”末，医院药房全部实现营业时有执业药师指导合理用药
D. 到“十二五”末，药品经营符合2010年修订的《药品经营质量管理规范》要求
E. 到“十二五”末，药品生产符合2010年修订的《药品生产质量管理规范》要求

正确答案：A、B、C、D、E。到“十二五”末，中药标准主导国际标准制定；到“十二五”末，零售药店全部实现营业时有执业药师指导合理用药；到“十二五”末，医院药房全部实现营业时有执业药师指导合理用药；到“十二五”末，药品经营符合2010年修订的《药品经营质量管理规范》要求；到“十二五”末，药品生产符合2010年修订的《药品生产质量管理规范》要求

解析：本题考查国家药品安全“十二五”规划指标。《国家药品安全"十二五"规划》指标：①全部化学药品、生物制品标准达到或接近国际标准，中药标准主导国际标准制定（A对）。医疗器械采用国际标准的比例达到90%以上。②2007年修订的《药品注册管理办法》施行前批准生产的仿制药中，国家基本药物和临床常用药品质量达到国际先进水平。③药品生产100%符合2010年修订的《药品生产质量管理规范》要求（E对）；无菌和置入性医疗器械生产100%符合《医疗器械生产质量管理规范》要求。④药品经营100%符合《药品经营质量管理规范》要求（D对）。⑤新开办零售药店均配备执业药师（B对）。2015年零售药店和医院药房全部实现营业时有执业药师指导合理用药（C对）。